重楼的别名是
A. 栝楼
B. 莎草根
C. 蚤休
D. 仙灵脾
E. 淡大芸

正确答案：C。蚤休

解析：本题考查的是常见饮片的正名与相关别名。重楼的别名是蚤休（C对）。重楼别名：七叶一枝花、蚤休、草河车。栝楼（A错）为瓜蒌的别名。瓜蒌别名：全瓜蒌、栝楼、药瓜。莎草根（B错）为香附的别名。香附别名：香附子、莎草根。仙灵脾（D错）为淫羊藿的别名。淫羊藿别名：仙灵脾。淡大芸（E错）为肉苁蓉的别名。肉苁蓉别名：淡大芸。